某化学药品生产企业计划从事疫苗生产活动，除已具备的药品生产基本条件外，还应具备的条件不包括
A. 具备适度规模和足够的产能储备
B. 具有保证生物安全的制度和设施设备
C. 符合疾病预防、控制需要
D. 符合所在地人口发展规划

正确答案：D。符合所在地人口发展规划

解析：本题考查从事疫苗生产活动具备的条件。从事疫苗生产活动的，还应当具备下列条件（1）具备适度规模和足够的产能储备（A对）。（2）具有保证生物安全的制度和设施、设备（B对）。（3）符合疾病预防、控制需要（C对）（D错，为本题正确答案）。